分布在胸腹部的经脉是
A. 足少阳胆经
B. 手少阴心经
C. 手太阴肺经
D. 足太阴脾经
E. 足阳明胃经

正确答案：E。足阳明胃经

解析：该题主要考察十二经脉的分布规律。手三阴经均从胸部行至腋下（BCD错）；手三阳经行于肩和肩脾部。足三阳经自上而下走行，则阳明经行于前（胸腹面）（E对），太阳经于后（背腰面），少阳经行于躯体两侧（A错）。